胎盘早剥出血发生在
A. 底蜕膜
B. 包蜕膜
C. 绒毛膜
D. 胎盘边缘血窦
E. 子宫腹腔动脉

正确答案：A。底蜕膜

解析：胎盘早剥的主要病理改变是底蜕膜出血（A对）并形成血肿，使胎盘从附着处分离。胎盘早剥按病理分为三种类型：显性剥离、隐性剥离、混合性出血。其中混合性出血为子宫肌瘤不能有效收缩以压迫胎盘边缘血窦破裂出血（D错）而止血，但该类型不常见。包蜕膜是覆盖在胚泡上的蜕膜，除包蜕膜和底蜕膜外，其余的蜕膜均称真蜕膜，随着妊娠进展，包蜕膜（B错）与真蜕膜相互贴近融合，到分娩时已无法分开。子宫腹腔动脉（E错）与胎盘早剥出血无关。